某男，27岁。暴发火眼，症见羞明多眵、红肿痛痒、迎风流泪。证属上焦火盛，宜选用的成药是
A. 明目地黄丸
B. 八宝眼药散
C. 黄连羊肝丸
D. 明目蒺藜丸
E. 复方血栓通胶囊

正确答案：D。明目蒺藜丸

解析：本题考查的是明目蒺藜丸的主治。暴发火眼，症见羞明多眵、红肿痛痒、迎风流泪。证属上焦火盛，宜选用的成药是明目蒺藜丸（D对）。明目蒺藜丸：【主治】上焦火盛引起的暴发火眼、云蒙障翳、羞明多眵、眼边赤烂、红肿痛痒、迎风流泪。明目地黄丸（A错）：【主治】肝肾阴虚所致的目涩畏光、视物模糊、迎风流泪。八宝眼药散（B错）：【主治】肝胃火盛所致的目赤肿痛、眼缘溃烂、畏光怕风、眼角涩痒。黄连羊肝丸（C错）：【主治】肝火旺盛所致的目赤肿痛，视物昏暗，羞明流泪，胬肉攀睛。复方血栓通胶囊（E错）：【主治】血瘀兼气阴两虚证的视网膜静脉阻塞，症见视力下降或视觉异常、眼底瘀血征象、神疲乏力、咽干、口干等；以及血瘀兼气阴两虚的稳定型劳累性心绞痛，症见胸闷痛、心悸、心慌、气短、乏力、心烦、口干等。